新生儿败血症最常见的病原菌是
A. 大肠杆菌
B. 绿脓杆菌
C. 链球菌
D. 念珠菌
E. 葡萄球菌

正确答案：E。葡萄球菌

解析：新生儿败血症是指病原体侵入新生儿血液循环并在其中生长、繁殖、产生毒素而造成的全身性炎症反应，常见病原体为细菌，我国多年来一直以葡萄球菌最多见（E对）。